对有毒金属的描述错误的是
A. As³⁺的毒性大于As⁵⁺
B. 正常人发砷＜5μg/g
C. 成人对铅较儿童更敏感
D. 镉广泛用于电镀、电池和颜料
E. 进入人体内的铅可长期蓄积

正确答案：C。成人对铅较儿童更敏感

解析：本题考查有毒金属的相关内容。儿童对铅较成人更敏感（C错，为本题正确答案），过量铅摄入可影响其生长发育，导致智力低下。铅在人体内的半衰期为4年，在骨骼的半衰期更长，可长达10年，故可长期在体内蓄积（E对）。镉广泛用于电镀、塑料、油漆等工业生产中（D对）。砷的毒性与其存在的形式和价态有关，As³⁺的毒性大于As⁵⁺（A对），无机砷的毒性大于有机砷。正常人发砷﹤5μg/g（B对）。